致龋微生物由母亲传播到婴幼儿口腔中的平均年龄是
A. 1～9个月
B. 9～18个月
C. 19～26个月
D. 19～31个月
E. 31～34个月

正确答案：D。19～31个月

解析：致龋微生物（变形链球菌）由母亲传播到婴幼儿口腔中的平均年龄是19～31个月，医学上称为感染窗口期。掌握“婴幼儿的口腔保健”知识点。